以下属于真性混合性牙源性肿瘤的是
A. 混合性牙瘤
B. 成釉细胞纤维瘤
C. 牙源性钙化囊性瘤
D. 牙源性腺样瘤
E. 组合性牙瘤

正确答案：B。成釉细胞纤维瘤

解析：成釉细胞纤维瘤主要特征是牙源性上皮和间叶组织同时增殖，但不伴牙本质和釉质形成，是一种真性混合性牙源性肿瘤。掌握“牙源性腺样瘤、成釉细胞纤维瘤”知识点。